淋巴结发育起始的胎龄是
A. 5周
B. 10周
C. 20周
D. 30周
E. 40周

正确答案：B。10周

解析：全身各部位的淋巴结发育的顺序不同，发育最早的是颈和肠系膜淋巴结，在胎龄10周（B对）时就已经出现。